帕金森病病损在
A. 中央前回
B. 锥体外系统
C. 小脑
D. 枕叶
E. 颞叶

正确答案：B。锥体外系统

解析：帕金森病的主要病理改变是黑质-纹状体多巴胺能通路变性，黑质多巴胺能神经元显著变性丢失，纹状体多巴胺递质水平显著降低导致基底核输出增加，皮质运动功能受到过度抑制，导致强直-少运动为主要表现的帕金森综合症。黑质-纹状体属于锥体外系统（B对），广义上的锥体外系是指锥体系以外的所有躯体运动的传导通路，包括纹状体系统和前庭小脑系统。中央前回（A错）刺激性格病变可导致对侧上、下肢或面部的抽搐（Jackson癫痫）或继发全身性癫痫发作；破坏性病变多引起单瘫。小脑（C错）病变主要表现为共济失调（P8）。枕叶（D错）病变时主要引起视觉障碍（P8）。颞叶（E错）病变时主要引起听觉、语言、记忆及精神活动障碍（P8）。